研究者对某铜矿厂全体男职工共150人开展一项前列腺癌筛查研究，筛查出阳性为100人，其中有73人确诊为前列腺癌：阴性为50人，确诊没有前列腺癌的为43人。则该检测方法的特异度为
A. 96%
B. 89%
C. 73%
D. 86%
E. 61%

正确答案：E。61%

解析：特异度又称真阴性率，指确诊的非病例中试验判断为阴性者所占的百分比，特异度=d/（b+d）×100%，其中d代表真阴性，b代表假阳性。根据题目描述，可知d为43，b为27，特异度=43/（43+27）×100%＝61%（E对）。